患者，女，16岁。1年来每逢月经来潮时下腹冷痛，拒按，得热痛减，经血量少，色暗有块，畏寒，舌淡暗，苔白腻，脉沉紧。治疗应首选的方剂是
A. 理冲汤
B. 膈下逐瘀汤
C. 少腹逐瘀汤
D. 血府逐瘀汤
E. 艾附暖宫丸

正确答案：C。少腹逐瘀汤

解析：本题患者为痛经表现，寒邪客于胞宫，血与寒结，冲任阻滞，经血流行不畅，故下腹冷痛。热能胜寒，得热寒凝之气则散，瘀滞稍通故痛减。血得寒则凝，故经量少、色暗有块。寒邪伤人阳气，脾阳不振，则畏寒。苔白、脉沉紧，均为寒邪内阻、气血瘀滞之象，宜用具有温经散寒，化瘀止痛的少腹逐瘀汤（C对）；理冲汤具有益气行血，调经祛瘀之功效。主治妇人经闭不行，或产后恶露不尽，结为癥瘕，以致阴虚作热，阳虚作冷，食少劳嗽，虚证沓来，室女月闭血枯，一切脏腑癥瘕、积聚、气郁、脾弱、满闷、痞胀，不能饮食（A错）；膈下逐瘀汤具有理气活血，逐瘀止痛的功效，可以治疗气滞血瘀证，症见经前或经期小腹胀痛，拒按，经血量少，经行不畅，色紫暗有块，块下痛减，经前胸胁、乳房胀满或胀痛。舌紫暗或边有瘀点，脉弦或弦滑（B错）；血府逐瘀汤具有活血化瘀，行气止痛之功效，主治胸中血瘀证。症见胸痛，头痛，日久不愈，痛如针刺而有定处，或呃逆日久不止，或饮水即呛，干呕，或内热瞀闷，或心悸怔忡，失眠多梦，急躁易怒，入暮潮热，唇暗或两目暗黑，舌质暗红，或舌有瘀斑、瘀点，脉涩或弦紧（D错）；艾附暖宫丸具有理气补血、暖宫调经的功效，用于治疗寒凝胞宫、血虚不荣、气滞血阻造成的痛经，缓解经期小腹冷痛坠胀，经血色暗、有血块，腰酸肢冷，乏力，面黄等症状（E错）。